不属于舍格伦综合征临床表现的是
A. 眼部表现
B. 口腔表现
C. 骨骼表现
D. 结缔组织疾病
E. 其他外分泌腺受累表现

正确答案：C。骨骼表现

解析：舍格伦综合征临床表现：①眼部表现；②口腔表现；③唾液腺肿大；④其他外分泌腺受累的表现；⑤结缔组织疾病；⑥其他并发症。该疾病为自身免疫性疾病。掌握“舍格伦综合征”知识点。